根据《中华人民共和国药品管理法实施条例》，审评直接接触药品包装材料和容器的是
A. 国务院药品监督管理部门
B. 省级药品监督管理部门
C. 设区的市级药品监督管理机构
D. 省级卫生行政部门
E. 国家中医药管理局

正确答案：A。国务院药品监督管理部门

解析：本题考查药品研制和注册。根据《中华人民共和国药品管理法实施条例》，审评直接接触药品包装材料和容器的是国务院药品监督管理部门（A对）。《中华人民共和国药品管理法》第二章药品研制和注册第二十五条：对申请注册的药品，国务院药品监督管理部门应当组织药学、医学和其他技术人员进行审评，对药品的安全性、有效性和质量可控性以及申请人的质量管理、风险防控和责任赔偿等能力进行审查；符合条件的，颁发药品注册证书。国务院药品监督管理部门在审批药品时，对化学原料药一并审评审批，对相关辅料、直接接触药品的包装材料和容器一并审评，对药品的质量标准、生产工艺、标签和说明书一并核准。本法所称辅料，是指生产药品和调配处方时所用的赋形剂和附加剂。